在比较A县与B县糖尿病死亡率时发现A县低于B县，但经年龄标化以后，A、B两县糖尿病标化死亡率相等，究其原因可能是
A. A县人口较B县年轻
B. B县人口较A县年轻
C. AB两县人口年龄构成相同
D. A县诊断水平高于B县
E. A县诊断水平低于B县

正确答案：A。A县人口较B县年轻

解析：本题考查率的标准化的应用。两个地区有相等的年龄调整死亡率，说明死亡危险是相同的。之所以粗死亡率不同，是年龄构成不同所造成的。在年龄调整死亡率相同的情况下，粗死亡率越低，说明当地年龄构成越年轻。因此A县较B县有更多的年轻人（A对BCDE错）。